等级评价是评价个体儿童的
A. 单项发育指标的等级
B. 多项发育指标的等级
C. 单项发育指标的等级发育速度
D. 单项发育指标随年龄发育变动的趋势
E. 各发育指标之间的相互关系

正确答案：A。单项发育指标的等级